选项中能体现医生遵守公正原则的是
A. 同情患者
B. 对待患者一视同仁
C. 保守患者的秘密和隐私
D. 选择对患者、对社会均有利的医疗卫生保健措施
E. 在诊治活动中杜绝有意和责任性伤害

正确答案：B。对待患者一视同仁

解析：公正原则要求医生公正地分配卫生资源、公正地对待患者和站在公正的立场上处理医疗差错事故等。掌握“医学伦理的基本原则”知识点。